男性，37岁，急刹车致使方向盘挤压上腹部16小时，上腹部腰部及右肩疼痛，持续性，伴恶心呕吐。查体：体温38.4℃，上腹部肌紧张明显，有压痛，反跳痛不明显，无移动性浊音，肠鸣音存在，怀疑胰腺损伤。如果行剖腹探查术，术中最有可能发现合并损伤的脏器是
A. 十二指肠
B. 胆总管
C. 横结肠
D. 右肾
E. 脾

正确答案：A。十二指肠

解析：胰腺右侧被十二指肠环绕，且两者关系紧密，因此胰腺损伤，尤其是胰头损伤常合并十二指肠损伤（A对）。胆总管（B错）位于胰腺和十二指肠的后方，位置深在，损伤机会不大，多由穿透伤引起（占85％）（七版黄家驷外科学P1329）。方向盘挤压引起的腹部损伤较少伤及横结肠（C错）、右肾（D错）、脾（E错）。